关于液体制剂质量要求的说法，错误的是
A. 口服混悬剂的沉降体积比应不低于0.90
B. 干混悬剂按干燥失重法测定，减失重量不得过2.0%
C. 干混悬剂按品种项下规定的比例加水振摇应均匀分散
D. 凡检查含量均匀度的口服混悬剂，一般不再进行装量检查
E. 凡检查分散均匀度的口服混悬剂，不再进行沉降体积比检查

正确答案：E。凡检查分散均匀度的口服混悬剂，不再进行沉降体积比检查

解析：本题考查的是液体制剂质量检查与要求。口服混悬剂照《中国药典》规定的方法检查，沉降体积比应不低于0.90（E错，为本题正确答案）。混悬剂系指难溶性固体药物以微粒状态分散于分散介质中形成的非均相的液体制剂，也包括干混悬剂。干混悬剂系指难溶性固体药物与适宜辅料制成粉末状或粒状物，临用时加水振摇即可分散成混悬液的制剂（C对）。混悬剂属于粗分散体系，且分散相有时可达总重量的50%。口服混悬液的质量要求：口服混悬剂应分散均匀，放置后若有沉淀物，经振摇应易再分散。口服混悬剂在标签上应注明“用前摇匀”；除另有规定外，口服混悬剂应进行以下相应检查。1.装量，另有规定外，单剂量包装的口服混悬液的装量，照下述方法检查，应符合规定。检查法：取供试品10袋（支），将内容物分别倒入经标化的量入式量筒内，检视，每支装量与标示装量相比较，均不得少于其标示量。凡规定检查含量均匀度者，一般不再进行装量检查（D对）。多剂量包装的口服混悬剂和干混悬剂照最低装量检查法检查，应符合规定。2.装量差异，除另有规定外，单剂量包装的干混悬剂照下述方法检查，应符合规定。检查法：取供试品20袋（支），分别精密称定内容物，计算平均装量，每袋（支）装量与平均装量相比较，装量差异限度应在平均装量的±10%以内，超出装量差异限度的不得多于2袋（支），并不得有1袋（支）超出限度1倍。3.干燥失重，除另有规定外，干混悬剂照干燥失重测定法测定，减失重量不得过2.0%（B对）。4.沉降体积比，口服混悬剂沉降体积比应不低于0.90（A对）。5.微生物限度检查，除另有规定外，照非无菌产品微生物限度检查：微生物计数法和控制菌检法及非无菌药品微生物限度标准检查，应符合规定。